社会医学创立的时间是
A. 18世纪
B. 16世纪
C. 19世纪
D. 17世纪
E. 20世纪

正确答案：C。19世纪

解析：本题考查社会医学创立的时间。社会医学创立的时间是19世纪（C对ABDE错）。